可单独用于轻度、早期高血压的药物是
A. 甘露醇
B. 氢氯噻嗪
C. 呋塞米
D. 阿米洛利
E. 螺内酯

正确答案：B。氢氯噻嗪

解析：本题考查利尿药。可单独用于轻度、早期高血压的药物是氢氯噻嗪（B对）。噻嗪类利尿药是治疗高血压的基础药物，安全、有效、价廉，可单用或与其他抗高血压药联合应用治疗各类高血压；单用适用于轻、中度高血压。甘露醇（A错）为渗透压利尿剂，临床用于预防急性肾衰竭、脑水肿及青光眼。呋塞米（C错）是高效利尿剂，高效利尿药不作为轻、中度高血压的一线药，而用于高血压危象及伴有慢性肾功能不良的高血压患者，因其增加肾血流量，并有较强的排钠利尿作用。阿米洛利（D错）和螺内酯（E错）都是保钾利尿剂，适用于低血钾症、高尿酸血症患者或原发性醛固酮增多症。